低钾血症一般不表现为
A. 碱中毒
B. 碱性尿
C. 心电图出现U波
D. 恶心呕吐
E. 腱反射减弱

正确答案：B。碱性尿

解析：低钾血症时，因为机体的代偿作用，肾远曲小管中Na⁺、K⁺交换减少，Na⁺、H⁺交换增加，使H⁺随尿排出增多，呈反常性酸性尿，而不是碱性尿（B错，为本题正确答案）。低钾血症可致代谢性碱中毒（A对），这是由于一方面K⁺由细胞内移出，与Na⁺、H⁺的交换增加，使细胞外液的H⁺浓度降低；另一方面，远曲肾小管Na⁺、K⁺交换减少，Na⁺、H⁺交换增加，使排H⁺增多，这两方面作用即可使病人发生低钾性碱中毒（“低血钾—碱中毒—反常性酸性尿”为外科考察中的一对常见组合）。U波（C对）为低血钾的特征性心电图表现。恶心呕吐（D对）为低钾血症引起的肠麻痹症状。腱反射减退（E对）为低血钾引发的神经肌肉常见表现。